某男性患者，29岁，体健。诉牙龈自发出血1月，熬夜3天后出血严重并伴有牙龈疼痛和口臭，伴有低热和全身乏力。最可能的诊断是
A. 边缘性龈炎
B. 疱疹性龈口炎
C. 青少年牙周炎
D. 牙间乳头炎
E. 急性坏死性溃疡性龈炎

正确答案：E。急性坏死性溃疡性龈炎

解析：本题考查急性坏死性溃疡性龈炎的特点。此患者为青年男性，发病过程急骤，且有牙龈疼痛和口臭，并伴有轻微的全身症状，此患者的表现符合急性坏死性溃疡性龈炎（NUG）（E对）的临床特征。边缘性龈炎（A错）又称慢性龈炎患者常在刷牙或咬硬物时牙龈出血，但一般无自发性出血，无自发痛，牙龈红肿，探诊出血，无全身症状。疱疹性龈口炎（B错）为病毒感染，好发于6岁以下儿童，其特征为口腔黏膜的成簇小水疱。青少年牙周炎（C错）一般发生在青春期左右，有典型牙周病表现。牙间乳头炎（D错）主要为龈乳头的充血肿胀，一般因机械或化学刺激引起。